下列哪项不是牙髓-牙周的解剖通道
A. 根尖孔
B. 侧支根管
C. 牙本质小管
D. 龋洞
E. 畸形舌侧沟

正确答案：D。龋洞

解析：牙周组织与牙髓组织在解剖学方面是互相沟通的，在组织学方面均来源于中胚叶或外中胚叶，两者之间的解剖通道为：根尖孔、侧支根管、牙本质小管、其他某些异常或病理情况如牙根纵裂、牙骨质发育不良、畸形舌侧沟等。掌握“牙周-牙髓联合病变”知识点。